对急性支气管炎与流行性感冒的鉴别，最有意义的是
A. 发热
B. 咳痰
C. 肺部啰音
D. 白细胞计数
E. 流行病学史

正确答案：E。流行病学史

解析：对急性支气管炎与流行性感冒的鉴别，最有意义的是流行病学史（E对），流行性感冒有流行病史，而急性支气管炎无流行病学史。急性支气管炎与流行性感冒均有发热（A错）、咳痰（B错）、肺部啰音（C错）、白细胞计数（D错）的表现。